霍乱患者腓肠肌痉挛的主要原因是
A. 肠毒素
B. 低钠血症
C. 脑水肿
D. 代谢性酸中毒
E. 低镁血症

正确答案：B。低钠血症